评价阿司匹林抗血小板作用的终点研究是
A. 冠脉综合征
B. 美尼尔综合征
C. 更年期综合征
D. 震颤麻痹综合征
E. 心脑血管事件

正确答案：E。心脑血管事件

解析：本题考查阿司匹林的不良反应。评价阿司匹林抗血小板作用的终点研究为心血管事件（E对），阿司匹林已经成为心血管事件一、二级预防的“基石”，并建议多数无禁忌证的不进行溶栓患者应在脑卒中后尽早（最好48h内）开始使用阿司匹林。冠脉综合征（A错）是评价他汀类药物调节血脂作用的终点研究。